防止感染最重要的手段为
A. 注射疫苗
B. 手术治疗
C. 药物治疗
D. 尽早清创
E. 以上都是

正确答案：D。尽早清创

解析：尽早清创是防止感染最重要的手段之一，在有条件时，应尽早进行清创缝合术；无清创条件时，应尽早包扎创口，防止外界细菌继续侵入。掌握“口腔颌面部创伤急救”知识点。